女，42岁。半小时前车祸受伤，右髋部疼痛剧烈，活动受限。查体：右髋部弹性固定，呈屈曲、内收、内旋畸形。最可能的诊断是
A. 股骨颈骨折
B. 髋关节中心脱位
C. 髋关节后脱位
D. 股骨转子间骨折
E. 髋关节前脱位

正确答案：C。髋关节后脱位

解析：中年女性，外伤致右髋部疼痛，活动受限，结合查体：右髋部弹性固定，呈屈曲、内收、内旋畸形，根据患者病史和临床表现最可能的诊断是髋关节后脱位（C对）。髋关节前脱位（E错）常有强大暴力所致外伤史，患肢呈外展、外旋和屈曲畸形（P656）。髋关节中心脱位（B错）由来自侧方的暴力所致，受伤时下肢处于轻度内收位或轻度外展与外旋位，肢体可缩短（P657）。股骨颈骨折（A错）多发于中、老年人，有摔倒受伤史，伤后感髋部疼痛，下肢活动受限，查体可发现患肢缩短、外旋畸形（P659）、内收（Pauwels大于50°）或外展（Pauwels小于30°）（P659）。股骨转子间骨折（D错）受伤后转子区出现疼痛、肿胀、瘀斑和下肢不能活动。检查发现转子间压痛，下肢外旋畸形明显，可达90°，患肢缩短（P661）。